多巴胺舒张肾血管是由于
A. 激动β受体
B. 激动α受体
C. 激动M胆碱受体
D. 激动多巴胺受体
E. 使组胺释放

正确答案：D。激动多巴胺受体

解析：多巴胺主要激动α受体、β受体和外周的多巴胺受体，但对于肾血管的作用表现具有双重作用的特点：小剂量时激动肾血管D₁（多巴胺）受体（D对），使血管舒张，肾血流量增加，肾小球滤过率增加，尿量增加；大剂量时则兴奋α₁受体，引起肾血管收缩，肾血流量减少，肾小球滤过率降低，尿量减少。